观察镜下牙本质的横剖磨片时，可见围绕成牙本质细胞突起的间质与其余部分不同，呈环形的透明带，称为
A. 管周牙本质
B. 管间牙本质
C. 球间牙本质
D. 前期牙本质
E. 原发性牙本质

正确答案：A。管周牙本质

解析：本题考查牙本质的发育，因矿化差异而有不同的名称。在镜下观察牙本质的横剖磨片时，可清楚地见到围绕成牙本质细胞突起的间质与其余部分不同，呈环形的透明带，称为管周牙本质（A对），它构成牙本质小管的壁，矿化程度高，含胶原纤维极少。位于管周牙本质之间的牙本质为管间牙本质（B错），是牙发育期间成牙本质细胞最初分泌的I型胶原原纤维网构成，矿化较管周牙本质低。在牙本质钙化不良时，钙质小球之间遗留一些未被钙化的间质称为球间牙本质（C错）。在成牙本质细胞和矿化牙本质之间总是有一层尚未矿化的牙本质存在为前期牙本质（D错）。牙发育过程中形成的牙本质为原发性牙本质（E错），它构成了牙本质的主体。